下列各项，不符合淤胆型肝炎临床表现的是
A. 黄疸深
B. 自觉症状重
C. 皮肤瘙痒
D. 大便颜色变浅
E. 血清胆固醇升高

正确答案：B。自觉症状重

解析：淤胆型肝炎是多种原因引起的肝细胞或毛细胆管胆汁分泌障碍，导致部分或完全性胆汁流阻滞为特征的综合征，主要表现为自觉症状轻（B错，为本题正确答案）、黄疸深（A对）、尿色深黄而大便颜色浅（D对）、皮肤瘙痒（C对）。淤胆型肝炎实验室检查呈“六高”现象：表现为血清总胆红素升高、碱性磷酸酶升高、γ-谷氨酰转酞酶升高、血清胆固醇升高（E对）、胆汁酸升高、β-球蛋白升高。